翼静脉丛
A. 位于翼腭窝内
B. 有颞浅静脉注入
C. 经腭大孔通口腔
D. 与颅内海绵窦相交通
E. 延续为下颌静脉

正确答案：D。与颅内海绵窦相交通

解析：面静脉通过眼上静脉和眼下静脉，面深静脉通过翼静脉丛与海绵窦交通（D对）。翼静脉丛延续为上颌静脉（E错）。